游离二氧化硅由于晶体结构不同致纤维性变能力表现为
A. 结晶型＞无定型＞隐晶型
B. 隐晶型＞结晶型＞无定型
C. 结晶型＞隐晶型＞无定型
D. 隐晶型＞无定型＞结晶型
E. 无定型＞隐晶型＞结晶型

正确答案：C。结晶型＞隐晶型＞无定型